患者，女，40岁。平素善惊易恐，现因受惊而心悸1个月余，坐卧不安，少寐多梦，舌苔薄白，脉虚弦，治疗应首选
A. 归脾汤
B. 炙甘草汤
C. 朱砂安神丸
D. 天王补心丹
E. 安神定志丸

正确答案：E。安神定志丸

解析：患者平素善惊易恐，现加之受惊，使心气不敛，心神动摇，发为心悸，少寐多梦；胆气怯弱，故坐卧不安；舌苔薄白，脉虚弦均符合心虚胆怯的舌脉，故辨为心虚胆怯证，治宜镇惊定志，养心安神。首选安神定志丸（E对）。归脾汤功能益气补血，健脾养心，为心悸心血不足证的选方（A错）。炙甘草汤功能益气滋阴，通阳复脉，用于气阴两虚，心动悸，脉结代之症（B错）。朱砂安神丸功能清心降火，重镇安神，常合天王补心丹治疗心悸阴虚火旺证（C错）。天王补心丹功能滋阴养血，补心安神，常合朱砂安神丸治疗心悸阴虚火旺证（D错）。